有关半抗原的叙述哪项是正确的
A. 分子量较大
B. 有免疫原性
C. 一般为蛋白质物质
D. 佐剂可以使其具有免疫原性
E. 具有抗原性

正确答案：E。具有抗原性

解析：半抗原只有抗原性没有免疫原性。半抗原单独进入机体不能刺激机体免疫系统产生抗体和致敏淋巴细胞。但是如果与蛋白质载体结合，就可以成为大分子量的完全抗原，而获得免疫原性。从而诱导机体产生特异性抗体。掌握“抗原基本概念、分类、超抗原及佐剂”知识点。